患儿，男，4岁。发热2天伴咽痛。查体：咽部充血，咽腭弓、悬雍垂、软腭处可见2mm～4mm大小疱疹。最可能的病原体是
A. 柯萨奇A组病毒
B. 呼吸道合胞病毒
C. 腺病毒
D. 鼻病毒
E. 冠状病毒

正确答案：A。柯萨奇A组病毒

解析：本题考查疱疹性咽峡炎的病原体。此患者为4岁儿童，有咽喉部肿胀症状，查体见咽部充血，咽腭弓、悬雍垂、软腭处可见2mm-4mm大小疱疹，此患者发病部位及症状符合疱疹性咽峡炎的临床表现。疱疹性咽峡炎为柯萨奇A4（A对）病毒引起的口腔疱疹损害。呼吸道合胞病毒（B错）、腺病毒（C错）、鼻病毒（D错）、冠状病毒（E错）感染多导致呼吸道感染症状，不符合题意。